以下有关聚羧酸锌粘固剂的论述中,不恰当的是
A. 对釉质和牙本质都有较大的黏着力
B. 能刺激修复性牙本质的形成
C. 可作为垫底材料
D. 聚羧酸锌粘固剂在唾液中的溶解度大于磷酸锌粘固剂
E. 对牙髓的刺激性较小

正确答案：B。能刺激修复性牙本质的形成

解析：本题考查聚羧酸锌水门汀。以下有关聚羧酸锌粘固剂的论述中,不恰当的是能刺激修复性牙本质的形成（B错，为本题的正确答案）。氢氧化钙是材料的活性成分，为碱性，具有杀菌和促进修复性牙本质形成的作用。聚羧酸锌粘固粉的抗压强度为53.9～73.5MPa，对釉质和牙本质都有较大的黏着力（A对），对牙髓的刺激性较小（E对），但不能刺激修复性牙本质的形成。聚羧酸锌粘固剂在唾液中的溶解度大于磷酸锌粘固剂（D对），绝缘性能稍差。